石菖蒲辛苦温，是临床常用的开窍药，其主治病证不包括
A. 胸痹心痛
B. 噤口痢
C. 心悸失眠
D. 耳鸣耳聋
E. 脘腹痞胀

正确答案：A。胸痹心痛

解析：本题考查的是石菖蒲的主治病证。石菖蒲辛苦温，是临床常用的开窍药，其主治病证不包括胸痹心痛（A错，为本题正确答案）。石菖蒲：【主治病证】（1）痰湿蒙蔽心窍之神昏，癫痫，耳聋，耳鸣（D对）。（2）心气不足之心悸失眠（C对）、健忘恍惚。（3）湿浊中阻之脘腹痞胀（E对），噤口痢（B对）。胸痹心痛为苏合香的主治病证。苏合香：【主治病证】（1）寒闭神昏。（2）胸痹心痛，胸闷腹痛。